英国药典的缩写是
A. BP
B. ChP
C. JP
D. Ph.Eur.
E. USP

正确答案：A。BP

解析：本题考查药典。《英国药典》缩写是BP（A对）。ChP（B错）是《中国药典》的缩写。JP（C错）是《日本药局方》的缩写。Ph.Eur.（D错）是《欧洲药典》的缩写。USP（E错）是《美国药典》的缩写。